食品生产经营过程必须符合下列卫生要求，但除外
A. 直接入口的食品应当有小包装或者使用无毒清洁的包装材料
B. 应当有相当的消毒，更衣、采光、通风、照明、防尘、洗涤、污水排放等设施
C. 保持内外环境整洁，采取消除苍蝇、老鼠、蟑螂和其他有害昆虫及其滋生条件的措施，与有毒、有害场所保持规定的距离
D. 食品生产经营企业取得卫生许可证
E. 食品生产经营企业应当有与产品品种数量相适应的食品原料处理、加工、包装、贮存等厂房或者场所

正确答案：D。食品生产经营企业取得卫生许可证